本身具有广谱抗菌作用，与磺胺类药物合用可显著增强抗菌作用的药物是
A. 丙磺舒
B. 克拉维酸
C. 舒巴坦钠
D. 他唑巴坦
E. 甲氧苄啶

正确答案：E。甲氧苄啶

解析：本题考查甲氧苄啶。甲氧苄啶（E对）本身具有广谱抗菌作用，与磺胺类药物合用可显著增强抗菌作用。丙磺舒（A错）是属于排尿酸的药物,主要应用于痛风缓解期控制尿酸。克拉维酸（B错）、舒巴坦钠（C错）均为β-内酰胺酶不可逆抑制剂。他唑巴坦（D错）是舒巴坦的衍生物。